治梅核气的药物是
A. 半夏
B. 天南星
C. 两者均是
D. 两者均不是

正确答案：A。半夏

解析：本题考查的是半夏的主治病证。治梅核气的药物是半夏（A对）。半夏：【主治病证】（1）痰多咳喘，痰饮眩悸，风痰眩晕，痰厥头痛。（2）胃气上逆，恶心呕吐。（3）胸脘痞闷，梅核气，瘿瘤痰核，痈疽肿毒。天南星（B错）：【主治病证】（1）顽痰咳嗽。（2）风痰眩晕，中风口眼㖞斜，癫痫，破伤风。（3）痈疽肿痛，瘰疬痰核。